每分钟肺泡通气量等于
A. 潮气量×呼吸频率
B. 肺通气量的1/2
C. （潮气量－生理无效腔）×呼吸频率
D. 功能余气量
E. （肺通气量－生理无效腔）×呼吸频率

正确答案：C。（潮气量－生理无效腔）×呼吸频率